性早熟是指
A. 女童在8岁以前出现乳房增大阴毛腋毛生长等第二性征的一种或一种以上者，均属性早熟
B. 包括真性性早熟假性性早熟和中性性早熟
C. 女童在12岁以前出现月经初潮，属性早熟
D. 女童在14岁以前出现第二性征发育，属性早熟
E. 有肿瘤引起的假性性早熟

正确答案：A。女童在8岁以前出现乳房增大阴毛腋毛生长等第二性征的一种或一种以上者，均属性早熟

解析：我国性早熟的年龄界限定义为：女孩8岁前、男孩9岁前出现性征发育，欧洲和日本的标准认为女性9.5～10岁前出现月经初潮也应属于性早熟的范畴。诊断程序首先应确定是否为性早熟；其次根据Tanner分期，确定性征的发育程度，再区分性早熟是中枢性还是外周性；还需要鉴别性早熟的病因，特发性还是器质性（A对）。性早熟的病因较为复杂，最新分为两大类，不包括中性性早熟（B错）。国际上一般把女孩8岁之前，男孩9岁之前出现第二性征发育定义为性早熟（CD错）。有肿瘤引起的假性性早熟是假性性早熟中的一种，不能涵盖性早熟的定义（E错）。